对患者自主与医生做主之间关系的正确理解是
A. 患者自主与医生做主是对立的
B. 患者自主与医生做主不是对立的
C. 强调患者自主，也充分看到医生做主的存在价值
D. 强调医生决定，兼顾患者自主
E. 强调患者自主，目的在于减轻医生的责任

正确答案：C。强调患者自主，也充分看到医生做主的存在价值